患者，女，63岁。急性心肌梗死行经皮冠状动脉介入（PCI）治疗，术后为预防支架内血栓形成，常与阿司匹林联合使用的药物是
A. 氯吡格雷
B. 双氯芬酸
C. 华法林
D. 奥美拉唑
E. 阿替普酶

正确答案：A。氯吡格雷

解析：本题考查用药选择。氯吡格雷（A对）用于治疗非ST段抬髙型急性冠脉综合征（包括不稳定型心绞痛或非Q波心肌梗死），也包括接受经皮冠状动脉介入术置入支架的患者，与阿司匹林合用。双氯芬酸（B错）用于急性关节炎症和痛风发作、慢性关节炎症、类风湿性关节炎、强直性脊柱关节和脊柱的其他炎性风湿性疾病。华法林（C错）用于预防房颤、心瓣膜疾病或人工瓣膜置换术后引起的血栓栓塞并发症。奥美拉唑（D错）用于胃溃疡、十二指肠溃疡、应激性溃疡、反流性食管炎和卓-艾综合征（胃泌素瘤）。阿替普酶（E错）用于急性心肌梗死、肺栓塞、缺血性脑卒中。